张某，患肺结核1年有余，曾予化疗药物，现请中医治疗症见咳嗽无力，气短声低，咯痰清稀，色白，量较多，午后潮热，伴有畏风怕冷，自汗与盗汗并见，纳少神疲，便溏，面白，舌质光淡，边有齿痕，苔薄，脉细弱而数其中医证型是
A. 肺阴亏损证
B. 阴虚火旺证
C. 气阴耗伤证
D. 阴阳两虚证
E. 肺气亏虚证

正确答案：C。气阴耗伤证

解析：患者患肺结核，现症见咳嗽无力，气短声低，咯痰清稀，色白，量较多，为气虚之证，午后潮热，伴有畏风怕冷，自汗与盗汗并见为阴虚之证，舌质光淡，边有齿痕，苔薄，脉细弱为气阴耗伤之症，故属气阴耗伤的证型（C对）。阴虚肺燥，肺失滋润，肺伤络损，故见干咳、咳声短促，或咯少量黏痰，或痰中带有血丝；苔薄白，边尖红为肺阴亏损之证（A错）。阴虚火旺证为阴液亏虚，虚火亢旺，以心烦失眠，口燥咽干，盜汗遗精，两颧潮红，小便短黄，大便干结，或咳血、衄血，或舌体、口腔溃疡，舌红少津，脉细数等（B错）。肺气亏虚证为咳喘无力、痰液清稀、畏风自汗等症状（E错）。